治疗晕动症，应选用
A. 后马托品
B. 托吡卡胺
C. 普鲁苯辛
D. 山莨菪碱
E. 东莨菪碱

正确答案：E。东莨菪碱

解析：东莨菪碱有防晕止吐作用，与苯海拉明合用能增强效果，用于晕车晕船，但出现晕动症状如恶心、呕吐后再用药则疗效差（E对）。后马托品用于散瞳验光及检查眼底（A错）。托吡卡胺用于散瞳检查眼底，验光配镜，虹膜状体炎（B错）。普鲁苯辛用于胃和十二指肠溃疡的辅助治疗，亦用于胃炎、胰腺炎、胆汁排泄障碍、多汗症、孕妇呕吐及遗尿（C错）。山莨菪碱应用于感染中毒休克、内脏平滑肌绞痛、血管神经性头痛、眩晕症（D错）。